抢救急性CO中毒时防止脑水肿
A. 静脉注射甘露醇、葡萄糖、速尿
B. 吸氧、高压氧舱疗法
C. 药物冬眠，给予ATP及细胞色素C
D. 保持呼吸道通畅，翻身及抗生素的应用
E. 立即将病人移到空气新鲜的地方

正确答案：A。静脉注射甘露醇、葡萄糖、速尿

解析：抢救急性CO中毒时防止脑水肿应静脉注射甘露醇、葡萄糖、速尿（A对）。吸氧、高压氧舱疗法（B错）主要目的是纠正组织缺氧，缩短昏迷时间及病程。保持呼吸道通畅，翻身及抗生素的应用（D错）主要目的是防治并发症和后遗症，如坠积性肺炎、压疮等。立即将病人移到空气新鲜的地方（E错）主要在于终止CO的吸入。药物冬眠，给予ATP及细胞色素C（C错）主要用于改善脑的代谢。